以下关于桩核冠理想根桩长度的说法中正确的是
A. 达根长的1/3即可
B. 应达根长的1/3～1/2
C. 应达根长的1/2～2/3
D. 应达根长的2/3～3/4
E. 应达根长的3/4～4/5

正确答案：D。应达根长的2/3～3/4

解析：桩的长度：为确保牙髓治疗效果和预防根折，一般要求根尖部保留3～5mm的充填材料，桩的长度为根长的2/3～3/4。掌握“桩核冠”知识点。